为了研究45岁以上的男性中体重指数（BMI）≥25者糖尿病患病率是否高于体重指数＜25者，某医生共调查了9550人，其中BMI≥25者有2110人（n1），糖尿病患病人数为226人（X1）；BMI＜25者7440人（n2），其中糖尿病患病人数为310人（X2）。问BMI≥25者糖尿病患病率是否高于BMI＜25者。若进行u检查，公式为
A. u=|p1-p2|/S（p1-p2）
B. u=|p-π|/Sp
C. u=|p1-p2|/σp
D. u=|p1-p2|/Sp
E. u=|p-π|/σp

正确答案：A。u=|p1-p2|/S（p1-p2）

解析：两个大样本的总体率的假设检验，即通过样本率P₁与P₂来推断π₁与π₂的关系。用μ检验的方法来进行二项分布两样本总体率的比较，则统计量μ的计算公式为|P₁-P₂|/S（P₁₋P₂）（A对）。